男，40岁。精神分裂症病史18年，第3次入院。入院后给予氟哌啶醇治疗，3天后加至30mg/d，第7天出现肌肉僵硬、震颤、吞咽困难，T39.8℃，意识不清，大汗淋漓，血清肌酸激酶增多。针对该患者的情况，有效的治疗药物是
A. β受体阻滞剂
B. 多巴胺受体激动剂
C. 广谱抗生素
D. 苯二氮䓬类药物
E. 抗胆碱能药物

正确答案：B。多巴胺受体激动剂

解析：该患者18年精神分裂症病史，第3次入院。入院后给予氟哌啶醇治疗，3天后加至30mg/d（药物加量过快，用量过高），第7天出现肌肉僵硬、震颤、高热，意识不清，大汗淋漓（自主神经功能紊乱），血清肌酸激酶增多，故最可能是恶性综合症。多巴胺受体激动剂治疗有效（B对）。苯二氮䓬类药物主要用于抗焦虑（D错）。抗胆碱能药物（盐酸苯海索治疗）一般用于椎体外系反应中的类帕金森症（E错）。